清虚热，清肺降火，生津止渴的药物是
A. 黄芩
B. 石膏
C. 青蒿
D. 鱼腥草
E. 地骨皮

正确答案：E。地骨皮

解析：地骨皮为清热药，甘、寒，归肺、肝、肾经，可凉血除蒸，清降肺火，可治疗阴虚潮热、骨蒸盗汗，肺热咳嗽，咯血，内热消渴。善于清虚热、除骨蒸，可清热泄火而生津止渴（E对），外感风寒发热或脾虚便溏者不宜用。黄芩具有清热燥湿，泻火解毒，止血，安胎的功效（A错）。石膏生用有清热泻火，除烦止渴的功效；煅用有收湿生肌，敛疮，止血的功效（B错）。青蒿有清虚热，除骨蒸，解暑热，截疟，退黄的功效（C错）。鱼腥草有清热解毒，消痈排脓，利尿通淋的功效（D错）。